下列关于儿童青少年人群发生单纯性肥胖敏感阶段的描述错误的是
A. 孕后期
B. 婴儿期
C. 幼儿期
D. 青春早期
E. 青春后期

正确答案：C。幼儿期